糖尿病肾病患者的蛋白质摄入量一般为每天每公斤体重
A. 0.4～0.6g
B. 0.6～0.8g
C. 0.8～1.0g
D. 1.0～1.1g
E. 1.1～1.2g

正确答案：B。0.6～0.8g

解析：本题考查糖尿病肾病患者的蛋白质摄入量。糖尿病肾病患者的蛋白质摄入量一般为每天每公斤体重0.6～0.8g（B对ACDE错）。